不符合热射病临床表现的是
A. 体温一般正常
B. 起病急
C. 多有意识障碍
D. 发病早期大量出汗、继而“无汗”

正确答案：A。体温一般正常

解析：本题考查热射病临床表现。热射病是指在热环境下作业时，人体内部和外部总体热负荷超过了散热能力，导致身体过热所致。其临床特点为突然发病（B对），体温升高可达40℃以上（A错，为本题正确答案），开始时大量出汗，以后出现“无汗”（D对），可伴有皮肤干热及意识障碍（C对）、嗜睡、昏迷等中枢神经系统症状，死亡率甚高。